尿道膜部是男性尿道穿经
A. 会阴浅隙之部分
B. 会阴深隙之部分
C. 盆膈之部分
D. 尿生殖膈之部分
E. 尿道球的部分

正确答案：D。尿生殖膈之部分

解析：男性尿道穿过尿生殖膈之部分（D对）为尿道膜部。